根据《城镇职工基本医疗保险定点零售药店管理暂行办法》，关于定点零售药店的做法，错误的是
A. 外配处方必须有医师签名和定点医疗机构盖章
B. 外配处方要有药师审核签字，并保存1年以备核查
C. 外配处方必须由定点医疗机构医师开具
D. 外配处方要分别管理、单独建账
E. 处方外配服务情况要定期向统筹地区社会保险经办机构报告

正确答案：B。外配处方要有药师审核签字，并保存1年以备核查

解析：本题考查的是《城镇职工基本医疗保险定点零售药店管理暂行办法》。根据《城镇职工基本医疗保险定点零售药店管理暂行办法》，关于定点零售药店的做法，错误的是外配处方要有药师审核签字，并保存1年以备核查（B错，为本题正确答案）。《城镇职工基本医疗保险定点零售药店管理暂行办法》第九条规定，外配处方必须由定点医疗机构医师开具（C对），有医师签名和定点医疗机构盖章（A对）。处方要有药师审核签字，并保存2年以上以备核查。《城镇职工基本医疗保险定点零售药店管理暂行办法》第十条规定，定点零售药店应配备专（兼）职管理人员，与社会保险经办机构共同做好各项管理工作。对外配处方要分别管理、单独建帐（D对）。定点零售药店要定期向统筹地区社会保险经办机构报告处方外配服务及费用发生情况（E对）。